患者久病湿疹，面垢多眵，大便溏泄，时发下痢脓血，小溲浑浊不清，湿疹浸淫流水，舌苔白厚腻，脉濡滑病属湿邪为患，此证反映了湿邪的哪种性质
A. 重着
B. 粘腻
C. 趋下
D. 秽浊
E. 类水

正确答案：D。秽浊

解析：“浊”，即秽浊。湿邪为患，易出现分泌物和排泄物秽浊不清的特征。如湿浊在上，则面垢、眵多；湿浊下注，则小便浑浊或滞涩不利、妇女白带过多；湿滞大肠，则大便溏泄、下痢脓血；湿邪浸淫肌肤，则可见湿疹浸淫流水等（D对）。“重”，即沉重、附着。湿邪致病，常出现以沉重感及附着难移为特征的临床表现，如头身困重、四肢酸楚沉重并且附着难移等；湿邪外袭肌表，困遏清阳，清阳不升，则头重如裹，如《素问·生气通天论》说：“因于湿，首如裹”湿邪阻滞经络关节，阳气不得布达，则可见肌肤不仁、关节疼痛沉重或屈伸不利等，病位多固定且附着难移，称之为“湿痹”或“着痹”（A错）。湿性黏滞：“黏”，即黏腻不爽；“滞”，即停滞。湿邪致病，其黏腻停滞的特性主要表现在两个方面：一是症状的黏滞性。湿邪为患，易呈现分泌物和排泄物黏滞不爽的特征，如湿热痢疾的大便排泄不爽，淋证的小便滞涩不畅，以及汗出而黏、口黏和舌苔厚滑黏腻等。二是病程的缠绵性。因湿性黏滞，易阻气机，气不行则湿不化，胶着难解，故湿邪为病，起病隐缓，病程较长，反复发作，或缠绵难愈。如湿温、湿疹、湿痹（着痹）等（B错）。湿邪类水属阴而有趋下之势，故湿邪为病，多易伤及人体下部。如水肿、湿疹、脚气等病，以下肢较为多见。小便浑浊、泄泻、下痢、妇女带下等，多由湿邪下注所致（C错，E错）。